在下列药物中，既可泻下攻积，又可利湿退黄的药物是
A. 栀子
B. 大黄
C. 金钱草
D. 茵陈蒿
E. 芒硝

正确答案：B。大黄

解析：大黄的功效是泻下攻积，清热泻火，凉血解毒，逐瘀通经，利湿退黄（B对）。栀子（A错）的功效是泻火除烦，清热利湿，凉血解毒，外用消肿止痛。金钱草（C错）的功效是利湿退黄，利尿通淋，解毒消肿。茵陈蒿（D错）的功效是清热利湿，利胆退黄。芒硝（E错）的功效是泻下通便，润燥软坚，清火消肿。